中性粒细胞减少是指总数低于
A. 0.5×10⁹/L
B. 2.0×10⁹/L
C. 1.5×10⁹/L
D. 3.0×10⁹/L
E. 0.2×10⁹/L

正确答案：B。2.0×10⁹/L

解析：白细胞减少＜4×10^9/L 中性粒细胞减少症＜2.0×10^9/L 粒细胞缺乏症＜0.5×10^9/L 。